安静时，给兔M受体阻断剂阿托品可引起心率明显增加，房室传导加速，若切断双侧迷走神经后再给阿托品，心脏的变化为
A. 心率明显增快
B. 心率明显降低
C. 心率无明显变化
D. 房室传导无明显变化
E. 房室传导明显减慢

正确答案：A。心率明显增快